属于医学伦理学基本规范的是
A. 公正
B. 权利
C. 廉洁奉公
D. 医德评价
E. 医患关系

正确答案：C。廉洁奉公

解析：医德的基本准则即医学伦理学的基本规范包括：以人为本，救死扶伤；严谨求实，精益求精；平等交往，一视同仁；举止端庄，语言文明；廉洁奉公（C对），遵纪守法；诚实守信，保守医密；互尊互学，团结协作；乐于奉献，热心公益。权力（B错）属于医学伦理学基本范畴。